3个月内的足月儿很少患营养性缺铁性贫血，主要原因是
A. 生长发育相对较慢
B. 红细胞破坏较少
C. 有充足的母乳喂养
D. 胎儿后期从母体内获得足够的储存铁
E. 铁排泄量少

正确答案：D。胎儿后期从母体内获得足够的储存铁

解析：本题考查营养性缺铁性贫血的相关内容。营养性缺铁性贫血以6月龄至3岁的婴幼儿发病最多，主要是食物中铁摄入不足，体内储存铁缺乏，导致血红蛋白合成减少而引起贫血。3个月内的足月儿很少患营养性缺铁性贫血，主要原因是胎儿后期从母体内获得足够的储存铁（D对ABCE错）。